同种药物的A、B两种制剂，口服相同剂量具有相同的AUC。其中制剂A达峰时间平均为0.5h，峰浓度平均值为116㎍/ml，制剂B达峰时间3h，峰浓度平均值73㎍/ml，关于A、B两种制剂的说法，正确的是
A. 两种制剂吸收速度不同，但利用程度相当
B. A制剂相对B制剂的相对生物利用度为100%
C. B制剂相对A制剂的绝对生物利用度为100%
D. 两种制剂具有生物等效性
E. 两种制剂具有治疗等效性

正确答案：A、B、D。两种制剂吸收速度不同，但利用程度相当；A制剂相对B制剂的相对生物利用度为100%；两种制剂具有生物等效性

解析：本题考查生物利用度与生物等效性。关于A、B两种制剂的说法正确的有：两种制剂吸收速度不同，但利用程度相当（A对），AUC表示利用程度，AUC相同故利用程度相同；A制剂相对B制剂的相对生物利用度为100%（B对）；由于是口服给药，所以是相对生物利用度，两种制剂具有生物等效性（D对）；绝对生物利用度是试验制剂的AUC与静脉注射给药的AUC的比值（C错）；E选项为干扰选项（E错）。